有助于发现和防范用药错误的措施有
A. 建立并使用用药错误报告系统
B. 使用ADEs电子检测系统
C. 利用条码技术鉴别患者身份，监测用药过程
D. 患者在就诊时提供现用药和曾用药清单，供医师参考
E. 对用药错误责任人进行惩罚

正确答案：A、B、C、D、E。建立并使用用药错误报告系统；使用ADEs电子检测系统；利用条码技术鉴别患者身份，监测用药过程；患者在就诊时提供现用药和曾用药清单，供医师参考；对用药错误责任人进行惩罚

解析：本题考查发现和防范用药措施。有助于发现和防范用药错误的措施有：建立并使用用药错误报告系统（A对）、使用ADEs电子检测系统（B对）、利用条码技术鉴别患者身份，监测用药过程（C对）、患者在就诊时提供现用药和曾用药清单，供医师参考（D对），对用药错误责任人进行惩罚（E对）。